随机抽取了10名肺气肿患者，测量他们在接受某一项治疗前后的呼吸量，资料如下：治疗前2750、2360、2950、2830、2260、2480、2650、2190、2940、2550；治疗后2850、2390、2990、2870、2330、2530、2690、2240、2980、2600，应选用何种统计方法分析治疗有无效果
A. 成组t检验
B. 两本率比较的t检验
C. 配对t检验
D. 秩和检验
E. 单因素方差分析

正确答案：C。配对t检验

解析：对同一受试对象进行两种不同的处理，配对样本T检验